下列单位违反法律、行政法规的规定，造成他人感染艾滋病病毒的，应当依法承担民事赔偿责任，但不包括
A. 血站
B. 单采血浆站
C. 医疗卫生机构
D. 血液制品生产单位
E. 卫生行政部门

正确答案：E。卫生行政部门

解析：血站、单采血浆站应当对采集的人体血液、血浆进行艾滋病检测；不得向医疗机构和血液制品生产单位供应未经艾滋病检测或者艾滋病检测阳性的人体血液、血浆。血液制品生产单位应当在原料血浆投料生产前对每一份血浆进行艾滋病检测。掌握“艾滋病的预防与控制、治疗与法律责任”知识点。